手术创伤对种植体的骨结合有一定的影响，由于钻孔产热过高，严格控制产热和散热，用骨钻钻孔时，速度不能超过
A. 500r/min
B. 1000r/min
C. 1500r/min
D. 2000r/min
E. 2500r/min

正确答案：D。2000r/min

解析：手术创伤种植手术时，由于钻孔产热过高，可使周围已分化和未分化的间叶细胞坏死。因此，手术中对骨组织活力的保护十分重要，即要求手术者操作精巧，严格控制产热和散热，用骨钻钻孔时，速度不能超过2000r/min，并以生理盐水注水降温。掌握“牙种植术概论”知识点。